治疗气瘿应首选
A. 海藻玉壶汤
B. 四海舒郁丸
C. 开郁散
D. 逍遥散
E. 桃红四物汤

正确答案：B。四海舒郁丸

解析：瘿病肿块按之坚实或有囊性感，患处不红不热，咽喉如有梅核堵塞，胸膈痞闷，女性患者常见月经不调，苔薄腻，脉滑者，用海藻玉壶汤加减以化痰软坚（A错）。气瘿多因忧郁情志内伤，以致肝脾气逆，脏腑失和而成，其肝郁气滞证应疏肝解郁，化痰软坚，方选四海舒郁丸加减，为首选方（B对）。肝气不舒，情志不畅，失其疏泄，气机不利，运化失司，痰气互结而致乳中结核类的乳房疾病，伴有胸闷不舒、乳房胀痛、舌苔白腻，脉弦滑等，用开郁散以疏肝解郁，化痰软坚，不是瘿病的选方（C错）。瘿病结块漫肿软绵或坚硬如石，发病与精神因素有关，或见急躁易怒，胸闷，善太息，苔薄白，脉弦滑者，用逍遥散加减以理气解郁，但无化痰软坚之功，不作为气瘿的首选方（D错）。瘿病肿块色紫坚硬，表面凹凸不平，推之不移，痛有定处，肌肤甲错，舌紫黯，有瘀点瘀斑，脉涩或沉细者，用桃红四物汤加减以活血化瘀（E错）。